内服不可持续服用，且忌“火煅”的药物是
A. 龙骨
B. 磁石
C. 牡蛎
D. 朱砂
E. 石决明

正确答案：D。朱砂

解析：本题考查的是朱砂的使用注意。内服不可持续服用，且忌“火煅”的药物是朱砂（D对）。朱砂：【使用注意】本品有毒，故内服不宜过量使用或久服，以免汞中毒；孕妇及肝肾功能不正常者慎服。火煅能析出水银而有大毒，故忌火煅。龙骨（A错）：【使用注意】本品性涩，故湿热积滞者忌服。磁石（B错）：【使用注意】本品为矿石类药物，服后不易消化，故脾胃虚弱者慎服。牡蛎（C错）：【使用注意】本品煅后收敛，故有湿热实邪者忌服。石决明（E错）：【使用注意】本品咸寒易伤脾胃，故脾胃虚寒、食少便溏者慎服。